可诱发胰腺炎，导致血清酯酶升高的抗艾滋病药品是
A. 利托那韦
B. 尼莫地平
C. 利巴韦林
D. 齐多夫定
E. 长春新碱

正确答案：A。利托那韦

解析：本题考查抗艾滋病药品的不良反应。利托那韦（A对）胃肠道的不良反应有恶心、呕吐、嗳气、口干、消化不良、食欲亢进、吞咽困难、畏食、胃肠功能紊乱、大便异常、大便失禁、便秘、涎腺炎、口炎（包括溃疡性口炎）、食管炎、胃肠炎、胆囊炎、胰腺炎（可有淀粉酶水平升高）、小肠结肠炎、出血性结肠炎。尼莫地平（B错）是二氢吡啶类钙通道阻滞剂，不用于艾滋病的治疗。利巴韦林（C错）是抗流感病毒药。齐多夫定（D错）可抑制髓造血功能，导致轻度贫血。长春新碱（E错）为抗肿瘤药。